女，25岁，争吵后右肢活动不便，言语不利两小时，病后无呕吐头痛，十年前曾患风湿热，查体，BP120/60mmHg，神志清醒，颈软，心率绝对不齐，二尖瓣舒张期杂音，运动性失语，右侧中枢面舌瘫，右侧肌力0～2级，张力低，头颅CT未见异常，诊断
A. 缺血性卒中
B. 蛛网膜下腔出血
C. 转向障碍
D. 低血糖
E. 脑出血

正确答案：A。缺血性卒中

解析：女，25岁，争吵后右肢活动不便，言语不利两小时，病后无呕吐头痛，十年前曾患风湿热，查体，bp120/60mmHg，神志清醒，颈软，心率绝对不齐，二尖瓣舒张期杂音，运动性失语，右侧中枢面舌瘫，右侧肌力0～2级，张力低（缺血性卒中的表现），头颅CT未见异常，结合患者的病史，表现和辅助检查，诊断为缺血性卒中（A对）。（P218）突然发生的连续性剧烈头痛、呕吐、脑膜刺激征阳性，伴或不伴意识障碍，检查无局灶性神经系统体征，应高度怀疑蛛网膜下腔出血。同时CT证实脑池和蛛网膜下腔高密度征象或腰穿检查示压力增高和血性脑脊液等可临床确诊（B错）。（P361）低血糖症 血糖水平低 2mml/L 时可产生局部癫痫样抽动或肢强直发作，伴意识丧失，见于胰岛B细胞瘤或长期服降糖药的2型糖尿病患者，病史有助于诊断（D错）。（P212）脑出血CT检查 病灶多呈圆形或卵圆形均匀高密度区，边界清楚,脑室大量积血时多呈高密度铸型，脑室扩大。1周后血肿周围有环形增强，血肿吸收后呈低密度或囊性变。脑室积血多在2～3周内完全吸收，而较大的脑实质内血肿一般需6～7周才可彻底消散（E错）。低血糖症不会出现活动不便，言语不利等表现，故除外。其余三种疾病的CT检查表现与缺血性卒中的CT检查表现不一样，故除外。